男，25岁。右膝关节和左足跟肿痛4周。曾有下半夜腰痛病史4年。查体：右膝肿胀压痛，浮髌征阳性，左侧“4”字征阳性，左侧骶髂关节压痛，左侧足跟肿胀压痛。化验回报：类风湿因子和抗CCP抗体阴性，HLA-B27阳性。右膝关节X片正常；骶髂关节X片显示双侧髂骨边缘虫蚀样破坏。可釆取的治疗措施是
A. 碳酸氢钠+苯溴马龙
B. 柳氮磺吡啶+关节内注射倍他米松
C. 氨基葡萄糖+双醋瑞因
D. 青霉素+甲氨蝶呤
E. 青霉素+阿奇霉素

正确答案：B。柳氮磺吡啶+关节内注射倍他米松

解析：患者化验回报： HLA-B27阳性，右膝关节X片正常，骶髂关节X片显示双侧髂骨边缘虫蚀样破坏，强直性脊柱炎诊断成立。该患者目前无炎性背痛，仅存在外周症状，故考虑为外周型强直性脊柱炎，可采取的治疗措施是柳氮磺吡啶+关节内注射倍他米松（B对），对周围关节及附着点炎症控制效果较好。碳酸氢钠+苯溴马龙（A错）用于治疗痛风。青霉素（DE错）为β内酰胺类抗生素，对强直性脊柱炎无效。氨基葡萄糖+双醋瑞（C错）主要用于治疗骨关节炎。